患儿，10个月，入院时诊断为腺病毒肺炎痰热闭肺证。今突然虚烦不安，额汗不温，口唇发绀。查体：体温38℃，呼吸64次/分，心率165次/分，心音低钝，肝脏比入院时增大2cm，舌暗紫，指纹沉而色青，达于命关。治疗首选
A. 西地兰加真武汤
B. 地塞米松加麻杏石甘汤
C. 西地兰加参附龙牡汤
D. 青霉素加生脉散
E. 地塞米松加参附龙牡汤

正确答案：C。西地兰加参附龙牡汤

解析：患儿虚烦不安，额汗不温，心率165次/分，心音低钝，为心动过速，使用西地兰强心，加强心肌收缩，用参附龙牡汤敛汗、潜阳，扶正固脱（C对）。真武汤主治阳虚水泛证（A错）。地塞米松加麻杏石甘汤用于治疗小儿肺炎高热惊厥（B错）。青霉素加生脉散治疗间质性肺炎（D错）。腺病毒肺炎痰热闭肺证并出现惊厥用地塞米松加参附龙牡汤（E错）。